药物经皮渗透速率与其理化性质有关，下列药物中，透皮速率相对较大的是
A. 熔点高的药物
B. 离子型的药物
C. 脂溶性大的药物
D. 分子极性高的药物
E. 分子体积大的药物

正确答案：C。脂溶性大的药物

解析：本题考查透皮速率。脂溶性大（C对）的药物容易进入角质层，因而透皮速率大。